流行性脑脊髓膜炎属于
A. 甲类传染病
B. 乙类传染病
C. 丙类传染病
D. 丁类传染病
E. 戊类传染病

正确答案：B。乙类传染病

解析：乙类传染病是指传染性非典型肺炎、艾滋病、病毒性肝炎、脊髓灰质炎、人感染高致病性禽流感、麻疹、流行性出血热、狂犬病、流行性乙型脑炎、登革热、炭疽、细菌性和阿米巴性痢疾、肺结核、伤寒和副伤寒、流行性脑脊髓膜炎、百日咳、白喉、新生儿破伤风、猩红热、布氏菌病、淋病、梅毒、钩端螺旋体病、血吸虫病、疟疾。掌握“传染病的概述”知识点。